慢性酒精中毒的震颤谵妄的临床表现是
A. 停酒后出现的急性精神症状群
B. 长期饮酒过程中出现的慢性精神症状群
C. 停酒后缓慢出现的记忆障碍
D. 长期饮酒过程中出现的记忆障碍
E. 长期饮酒过程中出现的行为改变

正确答案：A。停酒后出现的急性精神症状群

解析：慢性酒精性中毒的震颤谵妄：长期大量饮酒者如果突然断酒，表现为急性精神症状群，如震颤谵妄，意识模糊，分不清东南西北，不识亲人，不知时间，有大量的知觉异常，如常见形象歪曲而恐怖的毒蛇猛兽、妖魔鬼怪，患者极不安宁、情绪激越、大喊大叫（Ａ对）。记忆障碍是酒精依赖者神经系统的特有症状之一（如酒精性痴呆），长期、大量饮酒后出现的记忆障碍为酒精性痴呆的表现（C错）。